某男，62岁。干咳少痰，咽喉干痛、夜晚尤甚，舌红，脉细数。医师处以养阴清肺丸，该成药的功能有
A. 止咳祛痰
B. 敛肺止咳
C. 养阴润燥
D. 清肺利咽
E. 清肺化痰

正确答案：C、D。养阴润燥；清肺利咽

解析：本题考查的是养阴清肺丸的功能。干咳少痰，咽喉干痛、夜晚尤甚，舌红，脉细数。医师处以养阴清肺丸，该成药的功能有养阴润燥（C对）与清肺利咽（D对）。养阴清肺膏：【功能】养阴润燥，清肺利咽。杏苏止咳颗粒：【功能】宣肺散寒，止咳祛痰（A错）。强力枇杷露：【功能】清热化痰，敛肺止咳（B错）。清气化痰丸：【功能】清肺化痰（E错）。